牙髓切断术中及术后出现哪些情况时应改做根管治疗
A. 断髓后出血暗红，不易止血
B. 牙髓坏死、化脓
C. 术后观察出现炎症反应或叩痛
D. A+C
E. A+B+C

正确答案：E。A+B+C

解析：本题考查根管治疗的适应证。牙髓切断术是切除炎症牙髓组织，以盖髓剂覆盖于牙髓断面，保留正常牙髓组织的方法。术中断髓后出血暗红，不易止血（A对）说明可能牙髓已全部感染，不能保留部分牙髓，应去除所有牙髓组织进行根管治疗。牙髓坏死、化脓（B对）说明牙髓病变已很严重，若在断面覆盖盖髓剂会引起化脓性感染等严重并发症，应改为根管治疗。术后观察出现炎症反应或叩痛（C对）说明出现牙髓炎或根尖周病，应改为根管治疗。（ABC均对，故E为本题的正确答案）